青春期甲状腺Ⅱ度肿大最佳的治疗方法是
A. 多食含碘食物
B. 甲状腺次全切除术
C. 放射性碘治疗
D. 口服碘剂
E. 口服小剂量甲状腺素片

正确答案：E。口服小剂量甲状腺素片

解析：青春期甲状腺肿多可自行消退，轻度无症状的甲状腺肿可以暂时不予处理，密切观察临床症状和定期随访B超评估病情即可，用适量的甲状腺激素制剂，适用于各种病因引起的甲状腺肿。因此口服小剂量甲状腺素片是青春期甲状腺Ⅱ度肿大最佳的治疗方法（E对）。多食含碘食物（A错）和口服碘剂（D错）可以用于缺碘所致的甲状腺肿，但现在多被甲状腺激素制剂所取代。甲状腺次全切除术适用于腺体过大，有压迫症状，或有结节，怀疑发展为癌肿时的治疗，不适用于青春期甲状腺Ⅱ度肿大的治疗（B错）。放射性碘治疗适用于腺体过大，内科治疗无效且不能耐受手术治疗及手术后复发的患者，也不适用于青春期甲状腺Ⅱ度肿大（C错）。